某患儿，因鼻塞、咽痛，家长带其去医院就诊。经门诊查体和相关化验，医师诊断为普通感冒，并为该患儿开具小儿感冒颗粒，回家后，患儿家长在电视中看到小儿感冒颗粒的广告。结合题目提供的信息，关于小儿感冒颗粒的说法，正确的是
A. 一般情况下，该药无需经医师和药师指导，可以自行购买和使用
B. 该药只能凭处方在医院购买
C. 该药是非处方药
D. 该药标签上的忠告语是：在医师指导下购买使用

正确答案：C。该药是非处方药

解析：本题考查的是非处方药的广告管理。某患儿，因鼻塞、咽痛，家长带其去医院就诊。经门诊查体和相关化验，医师诊断为普通感冒，并为该患儿开具小儿感冒颗粒，回家后，患儿家长在电视中看到小儿感冒颗粒的广告。结合题目提供的信息，关于小儿感冒颗粒的说法，正确的是该药是非处方药（C对）。非处方药可以在大众媒介上进行广告宣传，但广告内容必须经过审查、批准，不能任意夸大或擅自篡改。麻醉药品、精神药品、医疗用毒性药品、放射性药品等特殊药品，药品类易制毒化学品，以及戒毒治疗的药品、医疗器械和治疗方法，不得作广告。处方药只能在国务院卫生行政部门和国务院药品监督管理部门共同指定的医学、药学专业刊物上作广告。非处方药广告的忠告语是：“请按药品说明书或在药师指导下购买和使用”（AD错）。非处方药是指由国家药品监督管理局公布的，不需要凭执业医师和执业助理医师处方（B错），消费者可以自行判断、购买和使用的药品。